测定某药物的比旋度时，配制药物浓度为10.0mg/ml的溶液，使用1dm长的测定管，依法测得旋光度为-1.75°，则比旋度为
A. ‘-1.75°
B. ‘-17.5°
C. ‘-175°
D. ‘-1750°
E. ‘-17500°

正确答案：C。‘-175°